有关颈内静脉的描述，正确的是
A. 是横窦的直接延续
B. 在颈内动脉内侧下行
C. 与头臂静脉合成上腔静脉
D. 与头臂静脉汇合处称静脉角
E. 主要属支为甲状腺上静脉和面静脉

正确答案：E。主要属支为甲状腺上静脉和面静脉

解析：颈内静脉是乙状窦（A错）的直接延续。沿颈内动脉和颈总动脉外侧（B错）下行。颈内静脉与锁骨下静脉（D错）汇合处称静脉角。主要属支为甲状腺上静脉和面静脉（E对）。